甲生物制品研发企业基于临床治疗需求，研发上市了一款针对PDL-1靶点用于肿瘤免疫治疗的新药，对多种肿瘤疾病疗效显著。为提升该药品的生产供应能力，甲计划在生产供应不足的情况下，同时委托乙药品生产企业生产，该新药销售由甲承担。下列对于甲的要求，正确的是
A. 经协议约定后，甲无须承担该药品受托生产的质量责任
B. 经协议约定后，甲无须承担该药品流通环节的质量责任
C. 甲委托乙生产的该药品上市销售前，应当经质量授权人签字放行
D. 甲从事该抗肿瘤药的生产活动应当经国家药品监督管理部门许可

正确答案：C。甲委托乙生产的该药品上市销售前，应当经质量授权人签字放行

解析：本题考查药品上市许可持有人的义务和权力。正确的是甲委托乙生产的该药品上市销售前，应当经质量授权人签字放行（C对）。建立药品上市放行规程并严格执行：药品上市许可持有人应当建立药品上市放行规程，对药品生产企业出厂放行的药品进行审核，经质量受权人签字后方可放行。不符合国家药品标准的，不得放行。药品委托生产管理：质量协议应当详细规定持有人和受托方的各项质量责任，并规定持有人依法对药品生产全过程中药品的安全性、有效性、质量可控性负责（AB错）。要求取得《医疗机构执业许可证》，且使用药物的医疗机构均应当接受考核，合理用药考核的重点内容，应当至少包括：①麻醉药品和精神药品、放射性药品、医疗用毒性药品、药品类易制毒化学品、含兴奋剂药品等特殊管理药品的使用和管理情况；②抗菌药物、抗肿瘤药物、重点监控药物的使用和管理情况等。考核采取医疗机构自查自评和卫生健康主管部门数据信息考核的方式进行（D错）。